男性，40岁，发热伴鼻出血一周。检查牙龈肿胀，肝脾轻度肿大；血红蛋白40g/L，白细胞6.0×10⁹/L，血小板15×10⁹/L，骨髓象原始细胞占60%，过氧化酶染色阳性，非特异性酯酶阳性，阳性反应可被氟化钠抑制，应诊断为
A. 急性粒细胞性白血病
B. 急性早幼粒细胞白血病
C. 急性淋巴细胞性白血病
D. 急性红白血病
E. 急性单核细胞性白血病

正确答案：E。急性单核细胞性白血病

解析：患者中年男性，发热伴鼻出血一周（发热、出血症状）。查体牙龈肿胀，肝脾轻度肿大（白血病细胞浸润可有肝脾肿大，牙龈增生、肿胀，后者尤以急性粒-单核细胞白血病、急性单核细胞白血病多见）；血红蛋白40g/L（成年男性Hb正常值120～160g／L），提示贫血，白细胞6.0×10⁹/L（正常4～10×10⁹／L）正常，血小板15×10⁹/L（正常100～300×10⁹/L）明显降低，骨髓象原始细胞占60％（原始细胞≥骨髓有核细胞（ANC）的30%（FAB分型）或≥20%（WHO分型）即可诊断为急性白血病），提示急性白血病，过氧化物酶染色阳性（符合急性非淋巴细胞白血病细胞化学染色特点），非特异性酯酶阳性，阳性反应可被氟化钠抑制（符合急性单核细胞白血病细胞化学染色特点），故患者应诊断为急性单核细胞白血病（E对）。急性粒细胞性白血病（A错）及急性早幼粒细胞白血病（B错）过氧化物酶染色阳性，但非特异性酯酶阳性，阳性反应不可被氟化钠抑制；急性淋巴细胞性白血病（C错）过氧化物酶染色及非特异性酯酶均为阴性；急性红白血病（P569）（D错）骨髓中幼红细胞≥50%。